男，16岁，发热，腹泻伴腹痛1周，T39℃，腹泻3-4次/天。查体：脾肋下3cm，移动性浊音（—），血WBC20×10⁹/L，E0.2，ALT98U/L，粪便见虫卵，根据流行病学表述,下列不正确的是
A. 家畜是重要的传染源
B. 感染后获得持久性免疫
C. 多发生在湖泽区
D. 钉螺为唯一的中间宿主
E. 接触疫水可感染

正确答案：B。感染后获得持久性免疫

解析：患者男，16岁，发热，腹泻伴腹痛1周。查体脾肋下3cm，血白细胞计数高，E0.2，ALT98U/L，粪便见虫卵，结合患者的表现，考虑为血吸虫病，血吸虫的终宿主包括人或哺乳动物如猪、牛等家畜（A对），中间宿主是钉螺（D对），钉螺一般存在于湖泊，接触疫水有感染的风险（E对），感染人群多发生在水源较多的地区（C对），血吸虫感染属于寄生虫感染，感染血吸虫后不能够获得持久性免疫（B错，为本题的正确答案）。